研究哪类成员最易将麻疹带入家中时用
A. 引入率
B. 续发率
C. 死亡率
D. 病死率
E. 发病率

正确答案：A。引入率